收缩压与舒张压之差为
A. 收缩压
B. 舒张压
C. 脉压
D. 体循环平均充盈压
E. 中心静脉压

正确答案：C。脉压

解析：收缩压与舒张压之差为脉压（C对）。收缩压（A错）是指心室收缩期中期达到最高值时的血压。舒张压（B错）是指心室舒张末期动脉血压达最低值时的血压。体循环平均充盈压（D错）可以表示循环系统中血液的充盈程度，其高低取决于血量和循环系统容积之间的相对关系。中心静脉压（E错）是指右心房和胸腔内大静脉血压。